女性，65岁，腹胀痛，腹泻、便秘交替月余，伴里急后重感，无鲜血便。体格检查：腹平软，未及包块，左锁骨上，腹股沟淋巴结未触及此病人主要的治疗应采取
A. 肠造瘘术
B. 根治性切除术
C. 化学治疗
D. 放射治疗
E. 免疫治疗

正确答案：B。根治性切除术

解析：老年女性患者，腹胀痛、腹泻便秘交替月余（直肠癌常见症状），伴里急后重感（直肠刺激征的表现），结合患者病史、临床表现和相关检查，应诊断为直肠癌。体格检查无腹部包块，左锁骨上和腹股沟淋巴结未触及肿块，说明没有转移，此病人应采取根治性切除术（B对）治疗。该病人未合并肠梗阻，故不应应用肠造瘘术（A错）。化学治疗（C错）和放射治疗（D错）可一定程度上提高手术疗效，但不应作为该病人的主要治疗方法。免疫治疗（E错）尚在研究阶段，不宜作为主要治疗方法。